哪种是副交感神经节
A. 椎旁节
B. 椎前节
C. 脊神经节
D. 器官旁节
E. 三叉神经节

正确答案：D。器官旁节

解析：周围部的副交感神经节，位于器官的周围或器官的壁内，称器官旁节（D对）和器官内节，节内的细胞即为节后神经元，位于颅部的副交感神经节较大，肉眼可见，有睫状神经节、下颌下神经节、翼腭神经节和耳神经节等。椎旁节（A错）和椎前节(B错)为交感神经。脊神经节（C错）和三叉神经节（E错）为感觉性神经节。